牙齿Ⅱ度松动是指
A. 用力摇动时有轻微动度
B. 颊舌向及近远中向均有动度
C. 颊舌向有动度
D. 近远中向及垂直向有动度
E. 颊舌向及垂直向有动度

正确答案：B。颊舌向及近远中向均有动度

解析：本题考查松动度检查。牙齿Ⅱ度松动是指颊舌向及近远中向均有动度（B对），幅度为1～2mm。仅有唇（颊）舌向松动（C错）是Ⅰ度松动。唇（颊）舌向及近远中向松动并伴有垂直向松动（DE错）是Ⅲ度松动。正常情况下，牙齿有轻微的生理动度（A错），单根牙的生理动度略大于多根牙。